根据蒙药理论，蒙药的药味有
A. 甘
B. 苦
C. 辛
D. 涩
E. 淡

正确答案：A、B、C、D。甘；苦；辛；涩

解析：本题考查的是蒙药理论的药味。根据蒙药理论，蒙药的药味有甘（A对）、苦（B对）、辛（C对）与涩（D对）。药味：药物有不同的味道，蒙药有六种药味，即甘、酸、咸、苦、辛、涩。这些味道是由于五元的元素（土、水、火、气、空）在药物形成过程中所造就程度和参与的量不同而形成的。蒙医认为一个独立的药味以两个元素含量为主，其他元素为辅。如甘味以土、水，酸味以火、土，咸味以水、火，苦味以水、气，辛味以火、气，涩味以土、气含量为主。淡（E错）属于中药药味。五味，即辛、甘、酸、苦、咸。有些药物具有淡味或涩味，所以实际上不止五种。但是习惯上仍然称为五味。其中辛、甘、淡属阳，酸、苦、咸属阴。